下列哪一项不是恶性高血压的临床症状
A. 头痛
B. 视力模糊
C. 眼底出血
D. 血尿
E. 腹痛

正确答案：E。腹痛

解析：少数恶性或急进型高血压患者病情急骤发展，舒张压持续≥130mmHg，并有头痛、视力模糊、眼底出血、渗出和视盘水肿，肾脏损害突出，持续蛋白尿、血尿与管型尿，称为恶性高血压。掌握“原发性高血压”知识点。